医学心理学对健康和疾病的观点不包括
A. 心身统一
B. 被动适应
C. 认知评价
D. 情绪影响
E. 个性特征

正确答案：B。被动适应

解析：随着社会的发展，健康的内涵在不断地发展，1990年世界卫生组织进一步到健康的定义作了补充：健康是指，一个人在身体健康、心理健康、社会适应健康和道德健康四个方面皆健全，即心身统一的观点（A对）。对于心理健康的判断标准有很多不同的理论学派，其中影响比较大的有马斯洛和米特尔曼提出的心理健康的十条标准：①有充分的自我安全感；②能充分了解自己，并能恰当估价自己的能力；③生活理想切合实际；④不脱离周围现实环境；⑤能保持人格的完整与和谐；⑥善于从经验中学习；⑦能保持良好的人际关系；⑧能适度地宣泄情绪和控制情绪；⑨在符合团体要求的前提下，能有限度地发挥个性；⑩在不违背社会规范的前提下，能适当地满足个人的基本需求；可综合概括为：认知评价的观点（C对）、个性特征作用的观点（E对）、情绪因素作用的观点（D）、主动适应的观点（B错，为本题正确答案），心理健康要求以积极的处世态度，与社会广泛接触，具有顺应社会改革变化的能力，是积极主动地适应，而非被动适应。